均能引起四环素牙的药物是
A. 先锋霉素、土霉素、盐酸四环素
B. 土霉素、去甲金霉素、盐酸四环素
C. 庆大霉素、盐酸四环素、缩水四环素
D. 青霉素、盐酸四环素、土霉素
E. 洁霉素、盐酸四环素、土霉素、去甲金霉素

正确答案：B。土霉素、去甲金霉素、盐酸四环素

解析：本题考查四环素类药物与牙着色。可引起四环素牙的药物有金霉素、去甲金霉素、土霉素、四环素、米诺环素（B对）。先锋霉素（A错）属于头孢菌素类抗生素，庆大霉素（B错）属于氨基糖苷类抗生素，青霉素（D错）为青霉素类抗生素，洁霉素（E错）（林可霉素）为林可霉素类抗生素，这四种药物均不属于四环素族药物，不会引起四环素牙。